营养性小细胞低色素性贫血
A. 红细胞脆性增加
B. 红细胞脆性降低
C. 红细胞酶缺陷
D. 血清铁蛋白减少
E. Coomb's试验

正确答案：D。血清铁蛋白减少

解析：本题考查营养性小细胞低色素性贫血的相关内容。在营养性小细胞低色素性贫血的早期，多为正常细胞性贫血，表现为血清铁蛋白减少（D对ABCE错）的轻度贫血；随着进展，红细胞和血红蛋白进一步下降，出现明显的小细胞低色素性贫血，呈典型的缺铁性贫血。所以出现典型小细胞低色素贫血，可见于缺铁性贫血的晚期。